男，50岁，不明原因晕厥，心电图示宽QRS波型心动过速，心室率150次/分，血压60/45mmHg，治疗首选
A. 临时心脏起搏器植入
B. 肾上腺素
C. 直流电复律
D. 毛花甙丙（西地兰）
E. 阿托品

正确答案：C。直流电复律

解析：患者中年男性，心电图示宽QRS波型心动过速，心室率150次/分（正常值60～100次/分，偏快），无更多的检查结果，故无法判断患者的心律失常类型，最可能为室性心动过速或室上性心动过速伴室内差异性传导。但患者血压60/45mmHg（正常值90～139/60～89mmHg，血压明显偏低，提示出现血流动力学紊乱），心室率快，不管何种心律失常治疗都应首选直流电复律（C对），立即改善血流动力学紊乱。临时心脏起搏器植入（A错）主要用于病态窦房结症状征和高度房室传导阻滞患者。肾上腺素（B错）常用于治疗过敏性休克和心脏骤停，对宽QRS波型心动过速无作用。毛花甙丙（西地兰）（P175）（D错）最适合用于有快速心室率的心房颤动并心室扩大伴左心室收缩功能不全者，多用于急性左心衰竭的强心治疗。阿托品（E错）可使心率加快，适用于缓慢型心律失常和房室传导阻滞。